由生甘草梢、木通、生地黄、竹叶组成的方剂是
A. 玉女煎
B. 凉膈散
C. 导赤散
D. 清胃散
E. 犀角地黄汤

正确答案：C。导赤散

解析：本题考查方剂的组成，由考点还原可知导赤散由生甘草梢、木通、生地黄、竹叶组成（C对）。玉女煎组成石膏、熟地、麦冬、知母、牛膝（A错）。凉膈散组成川大黄、朴硝、甘草、山栀子仁、薄荷、黄芪、连翘、蜂蜜（B错）。清胃散组成生地黄、当归身、牡丹皮、黄连、升麻（D错）。犀角地黄汤组成犀角、生地黄、芍药、牡丹皮（E错）。